关于D值与z值的表述，不正确的有
A. D值系指一定温度下，将微生物杀灭90%所需的时间
B. D值系指一定温度下，将微生物杀灭10%所需的时间
C. D值小，说明该微生物耐热性强
D. D值小，说明该微生物耐热性差
E. Z值系指某一种微生物的D值减少到原来的1/10时所需升高的温度值

正确答案：A、D、E。D值系指一定温度下，将微生物杀灭90%所需的时间；D值小，说明该微生物耐热性差；Z值系指某一种微生物的D值减少到原来的1/10时所需升高的温度值